以下哪组牙齿易发生冠周炎
A. 上颌尖牙
B. 下颌第一磨牙
C. 下颌第二乳磨牙
D. 上颌第三磨牙
E. 下颌第三磨牙

正确答案：E。下颌第三磨牙

解析：本题考查智齿冠周炎。下颌第三磨牙（E对）易发生冠周炎。智牙冠周炎是指智牙（第三磨牙）萌出不全或阻生时，牙冠周围软组织发生的炎症。临床上以下颌智牙冠周炎多见，上颌第三磨牙冠周炎发生率较低（D错）。